属于胆碱酯酶复活药的是
A. 碘解磷定
B. 有机磷酸酯类
C. 乙酰胆碱
D. 氨甲酰胆碱
E. 毒扁豆碱

正确答案：A。碘解磷定

解析：碘解磷定属于胆碱酯酶复活药。掌握“难逆性抗胆碱酯酶药及胆碱酯酶复活药”知识点。